铬引起的癌多为
A. 鳞癌
B. 腺癌
C. 扁平细胞角化癌
D. 基底细胞癌
E. 未分化小细胞癌

正确答案：A。鳞癌

解析：本题考查铬的致癌性。铬酸盐可经呼吸道、消化道和皮肤吸收。所有铬的化合物都有毒性，三价铬是人体必需微量元素，毒性很小，六价铬毒性比三价铬高。职业性致癌因素种类不同，各自导致的职业性肿瘤具有不同的特定病理类型，铬暴露多致肺鳞癌（A对BCDE错）。